弥散障碍时血气变化是
A. PaO₂降低
B. PaCO₂正常
C. PaO₂升高
D. PaCO₂升高
E. PaCO₂降低

正确答案：A。PaO₂降低

解析：弥散障碍时血气变化是PaO₂降低（A对），但不会使PaCO₂增高。